虎斑心
A. 细胞水肿
B. 玻璃样变
C. 粘液变性
D. 淀粉样变
E. 脂肪沉积（脂肪变性）

正确答案：E。脂肪沉积（脂肪变性）

解析：虎斑心是因心肌发生脂肪变性时，脂肪沉积（E对）在心肌呈黄色，与正常心肌的暗红色相间，形成黄红色斑纹，状似虎斑而得名。细胞水肿（A错）又称水样变（P15），是指因胞质内离子浓度调节功能障碍导致细胞内大量水分蓄积的现象。玻璃样变（P16）（B错）是指细胞内或间质中出现半透明状蛋白质蓄积的现象。粘液变性（P17）（C错）是指细胞间质内出现黏多糖（葡萄糖胺聚糖、透明质酸等）和蛋白质蓄积的现象。淀粉样变（P17）（D错）是指细胞间质内出现淀粉样蛋白质和黏多糖复合物蓄积的现象，具有淀粉染色的特征。